吴茱萸除散寒止痛、燥湿止泻外，又能
A. 疏肝下气
B. 温肺化饮
C. 回阳救逆
D. 活血通络
E. 祛风止痒

正确答案：A。疏肝下气

解析：本题考查的是吴茱萸的功效。吴茱萸除散寒止痛、燥湿止泻外，又能疏肝下气（A对）。吴茱萸：【功效】散寒止痛，疏肝下气，燥湿止泻。干姜：【功效】温中，回阳，温肺化饮（B错）。附子：【功效】回阳救逆（C错），补火助阳，散寒止痛。刺五加：【功效】补气健脾，益肾强腰，养心安神，活血通络（D错）。地肤子：【功效】利尿通淋，祛风止痒（E错）。